清经散的组成是
A. 丹皮、赤芍、地骨皮、黄芩、黄柏、茯苓、 生地
B. 丹皮、地骨皮、青蒿、黄柏、茯苓、黄芩、 麦冬
C. 丹皮、青蒿、黄芩、黄柏、茯苓、赤芍、地骨皮
D. 丹皮、地骨皮、白芍、熟地、青蒿、黄柏、茯苓
E. 丹皮、地榆、白芍、生地、黄柏、茯苓、 青蒿

正确答案：D。丹皮、地骨皮、白芍、熟地、青蒿、黄柏、茯苓

解析：清经散《傅青主女科》 清热养阴，凉血调经，由丹皮 地骨皮 白芍 熟地黄 青蒿 黄柏 茯苓组成,方歌：傅氏女科清经散，芍药丹皮茯苓掺，蒿地黄柏地骨皮，血热经多功效赞。用于月经先期之阳盛血热证（D对）。